观察舌苔辨别病邪性质主要依据
A. 舌苔的有无
B. 舌苔的润燥
C. 舌苔的厚薄
D. 舌苔的颜色
E. 舌苔的有根与无根

正确答案：D。舌苔的颜色

解析：舌苔的颜色反映病邪的性质，如白苔为正常舌苔，亦主表证、寒证；黄苔主热证、里证；灰黑苔主阴寒内盛，或里热炽盛等（D对）。舌苔的有无反映胃气的盛衰（A错）。舌苔的润燥反映津液的盈亏（B错）。舌苔的厚薄可测定正邪盛衰和病情的深浅轻重（C错）。舌荅的有根与无根反映胃气的有无（E错）。